磁石不具有的功效是
A. 镇惊安神
B. 平肝潜阳
C. 聪耳明目
D. 活血散瘀
E. 纳气平喘

正确答案：D。活血散瘀

解析：本题考查的是磁石的功效。磁石不具有的功效是活血散瘀（D错，为本题正确答案）。磁石：【功效】镇惊安神（A对），平肝潜阳（B对），聪耳明目（C对），纳气平喘（E对）。活血散瘀为琥珀的功效。琥珀：【功效】安神定惊，活血散瘀，利尿通淋。